活性氧不包括
A. H202
B. OH•
C. 102
D. Cl•
E. LOO•

正确答案：D。Cl•

解析：这些化合物与含氧自由基统称为活性氧，活性氧包括超氧阴离子(Oi)、轻自由基(OH·)（B对）、LOO•（E对）和一氧化氮自由基(NO·)，OH·是目前发现最活跃的氧自由基。体内还有其他的化学性质活泼的含氧化合物，如过氧化氢(H202)（A对）、单线态氧( 102)（C对）、臭氧等。活性氧不包括Cl•（D错，为本题正确答案）。